女，35岁。下肢严重挤压伤2小时。查体：BP105/70mmHg。实验室检查：血清K⁺6.0mmol/L，Na⁺138mmol/L，Cl⁻105mmol/L。该患者最可能出现的酸碱平衡紊乱是
A. 细胞外液碱中毒、尿液呈酸性
B. 细胞外液酸中毒、尿液呈酸性
C. 细胞外液酸中毒、尿液呈碱性
D. 细胞内液碱中毒、尿液呈酸性
E. 细胞外液碱中毒、尿液呈碱性

正确答案：C。细胞外液酸中毒、尿液呈碱性

解析：下肢严重挤压伤时，组织分解代谢增加，钾由细胞内释放到细胞外液，造成细胞外液K⁺升高（该患者血清K⁺6.0mmol/L，高于正常3.5～5.5mmol/L），K⁺与细胞内H⁺交换，引起细胞外H⁺增加，导致代谢性酸中毒。肾小管细胞内高K⁺，K⁺-Na⁺交换增加，H⁺-Na⁺交换减少，H⁺排出减少，尿液呈碱性，称为反常性碱性尿。